男，33岁。急性腹膜炎术后7天。发热，为弛张热，伴乏力盗汗纳差，右上腹肋下持续性纯痛，深呼吸及咳嗽时疼痛加重。腹部B超及CT示肝右叶上方，膈肌下见6cm×4cm液气平面。诊断性穿刺可抽出脓液。最常用的抗生素是
A. 半合成青霉素
B. 克林霉素
C. 第二代头孢菌素
D. 氨基糖苷类
E. 第三代头孢菌素

正确答案：E。第三代头孢菌素

解析：青年男性患者，急性腹膜炎（腹腔脓肿的常见原因）术后出现发热，右上腹、肋下持续性纯痛，深呼吸及咳嗽时疼痛加重（膈下脓肿的可疑表现），腹部B超及CT示肝右叶上方、膈肌下见一液气平面，诊断性穿刺可抽出脓液（提示膈下脓肿），结合患者病史和相关检查，应诊断为右侧膈下脓肿。由于继发性腹膜炎引起的膈下脓肿多为混合感染，致病菌以大肠埃希菌最为常见，其次为链球菌、厌氧拟杆菌等。第三代头孢菌素（E对）可以杀死大肠埃希菌而无耐药性，因此是膈下脓肿最常用的抗生素。半合成青霉素（A错）对革兰阴性杆菌（如大肠埃希菌）有效，但易产生耐药性。克林霉素（B错）对于革兰阳性球菌（如金黄色葡萄球菌）的杀菌作用较好，但对革兰阴性杆菌效果欠佳。第二代头孢菌素（C错）对革兰阴性杆菌的抗菌效果不及三代头孢。氨基糖苷类（D错）有肾毒性，且在腹腔感染的低pH环境中效果不大。